在盲法试验中，双盲试验是指
A. 仅试验者知道分组情况
B. 试验者和检验者知道分组情况
C. 受试者和检验者不知道分组情况
D. 试验者和受试者都不知道分组情况
E. 检验者和试验者都不知道分组情况

正确答案：D。试验者和受试者都不知道分组情况

解析：本题考查盲法的设计。在盲法试验中，双盲试验是指试验者和受试者都不知道分组情况（D对）。盲法设计可以根据程度分下述几种：1.单盲：仅试验者知道分组情况（A错），受试者不知道自己属于试验组还是对照组。这种设计虽然消除了来自受试者的主观影响，但不能去除试验者的影响，这种设计主要适用于仅仅根据受试者主诉来判断试验结果的临床试验。2.双盲：试验者和受试者都不知道分组结果，试验者不知道哪个受试者被分配在哪组，受试者不知道自己被施以何种干预措施。这样可以消除试验者和受试者两方面的主观因素影响，保持试验公正客观，这是临床试验用得最多的盲法设计。